香豆素苷类化合物的提取分离可用
A. 重结晶法
B. 升华法
C. 碱溶酸沉法
D. 系统溶剂法
E. 色谱法

正确答案：C、D、E。碱溶酸沉法；系统溶剂法；色谱法